正中神经返支
A. 支配鱼际肌
B. 自屈肌支持带下缘发出
C. 正中神经的皮支
D. 支配第1、2骨间肌
E. 支配全部蚓状肌

正确答案：B。自屈肌支持带下缘发出

解析：正中神经在手部屈肌支持带的下方正中神经发出一粗短的返支，行于桡动脉掌浅支外侧进入鱼际，支配除拇收肌以外的鱼际肌群（A错B对）。正中神经的运动纤维支配第1、2蚓状肌（DE错）。